癌基因异常激活的主要方式除外的是
A. 获得启动子和（或）增强子
B. 染色体易位
C. 原癌基因扩增
D. 异常活化
E. 点突变

正确答案：D。异常活化

解析：癌基因异常激活的主要方式为：获得启动子和（或）增强子；染色体易位；原癌基因扩增；点突变。掌握“癌基因与抑癌基因以及生长因子”知识点。